医德修养的根本途径和方法是
A. 学习医德理论知识
B. 在医疗卫生保健实践中修养
C. 有的放矢
D. 持之以恒
E. 追求慎独

正确答案：B。在医疗卫生保健实践中修养